涎瘘的完全性瘘每日流出的唾液量可多达
A. 500ml以上
B. 800ml以上
C. 1000ml以上
D. 1500ml以上
E. 2000ml以上

正确答案：E。2000ml以上

解析：完全性瘘每日流出的唾液量可多达2000ml以上，瘘口周围皮肤被唾液激惹而表现为潮红、糜烂或伴发湿疹。掌握“涎瘘”知识点。